男，20岁。跨栏比赛时会阴部受伤。伤后会阴部疼痛、青紫，尿道出血，不能自行排尿。应考虑的诊断是
A. 尿道球部损伤
B. 耻骨骨折
C. 后尿道损伤
D. 睾丸损伤
E. 膀胱破裂

正确答案：A。尿道球部损伤

解析：青年男性患者，会阴部骑跨伤（提示可能有前尿道损伤）后，会阴部疼痛青紫（前尿道损伤的表现），尿道出血，不能自行排尿，结合患者病史和临床表现，应考虑的诊断是尿道球部损伤（A对）。耻骨骨折（B错）可出现特征性的会阴部青紫及瘀斑，但一般不会影响排尿。后尿道损伤（C错）多见于骨盆骨折，可出现排尿困难、少量尿道出血，但一般不出现会阴部瘀斑。睾丸损伤（D错）不会出现排尿困难。膀胱破裂（E错）多见于骨盆骨折，主要表现为腹痛、排尿困难和血尿，一般不出现会阴、阴囊部青紫、瘀斑。